一个患者腹痛已5天，如果怀疑急性胰腺炎，最有诊断意义的指标是
A. 血清淀粉酶
B. 白细胞计数
C. 血清脂肪酶
D. 血清钙
E. 血清正铁血红蛋白

正确答案：C。血清脂肪酶